下列各项，不属于有机磷酸农药中毒治疗中“阿托品化”临床表现的是
A. 瞳孔较前扩大
B. 心率加快
C. 流涎加重
D. 颜面潮红
E. 肺部湿啰音消失

正确答案：C。流涎加重

解析：本题考查有机磷酸农药中毒治疗中“阿托品化”的临床表现。流涎加重（C错，为本题的正确答案）为有机磷农药中毒的表现。有机磷酸农药中毒治疗中给予阿托品治疗，可使患者M样症状消失，瞳孔较前扩大（A对），还可出现颜面潮红（较大剂量的阿托品可引起皮肤血管扩张）（D对），阿托品化指征为口干、皮肤干燥、心率增快（90～100次/分）（B对）和肺湿啰音消失（E对）。